本身具有活性，在体内不发生代谢或化学转化的药物是
A. 代谢拮抗物
B. 生物电子等排体
C. 前药
D. 硬药
E. 软药

正确答案：D。硬药